治疗牙痛风火证，除取主穴外，应加
A. 头维、外关
B. 外关、风池
C. 外关、曲池
D. 太溪、行间
E. 太溪、三阴交

正确答案：B。外关、风池

解析：针灸治疗牙痛总治法为祛风泻火、通络止痛，选穴以手足阳明经为主。主穴选颊车、下关、合谷；风火牙痛加外关、风池。风火牙痛病是因为风邪外袭经络，郁于阳明而化火，火邪循经上炎而发病，又阳明经脉分别入上、下齿，所以可引起牙痛风火证，治疗取风池、外关，可疏解表邪，祛风热（B对）。头维主要用于治疗头痛、目眩、目痛等头目病症（A错）。曲池主要用于治疗上肢不遂等上肢病证、热病、腹痛吐泻等肠胃病证（C错）。太溪、行间用于阴虚牙痛以补肾泻火止痛（D错）。三阴交主要用于治疗肠鸣腹胀、腹泻等脾胃虚弱诸证；月经不调、带下、阴挺、不孕、滞产等妇产科病症；遗精、阳痿、遗尿等生殖泌尿系统疾患；心悸，失眠，高血压；下肢痿痹；阴虚诸证（E错）。